臭氧层破坏的主要危害是
A. 加速酸雨形成
B. 有利于啮齿动物、昆虫生长繁殖
C. 使人类皮肤癌、白内障发病率增加
D. 不利于植物生长
E. 光敏感性皮肤病发病率增加

正确答案：C。使人类皮肤癌、白内障发病率增加

解析：本题考查臭氧层破坏的主要危害。臭氧层被破坏形成空洞以后，减少了臭氧层对短波紫外线和其他宇宙射线的吸收和阻挡功能，造成人群皮肤癌和白内障等发病率的增加（C对ABDE错），对地球上的其他动植物也有杀伤作用。